小儿风湿热诊断标准中的主要表现不包括
A. 发热
B. 心肌炎
C. 多关节炎
D. 环形红斑
E. 皮下小结

正确答案：A。发热

解析：风湿热对诊断标准包括3个部分：主要指标、次要指标、链球菌感染的证据。其中主要表现包括：心脏炎（B对）、多关节炎（C对）、舞蹈病、环形红斑（D对）、皮下小结（E对）。发热（A错，为本题正确答案）是小儿风湿热的一般表现，不是主要表现。